某学者对某社区进行有关吸烟和肺癌的关系，对该社区中吸烟和不吸烟进行分组跟踪观察其肺癌的发生率。则该研究方法属于
A. 病例对照研究
B. 前瞻性研究
C. 历史性研究
D. 创新性研究
E. 队列研究

正确答案：E。队列研究

解析：队列研究是将人群是否暴露于某可疑因素及其暴露程度分为不同亚组，追踪其各自的结局，比较不同亚组之间结局频率的差异，从而判定暴露因素与结局之间有无因果关联及关联的大小的一种观察性研究。本题中对该社区中吸烟和不吸烟进行分组，跟踪观察其肺癌的发生率，研究吸烟与肺癌的关系，该研究方法属于队列研究（E对）。